HIV的确认试验为
A. ELISA测HIV抗体
B. 免疫蛋白印迹法测HIV抗体
C. 血凝试验测HIV抗体
D. 胶体金免疫层析法测HIV抗体
E. 放射免疫法测HIV抗体

正确答案：B。免疫蛋白印迹法测HIV抗体

解析：本题考查HIV的明确诊断实验方法。免疫蛋白印迹法测HIV抗体（B对）是HIV的确诊实验方法。